可引起横纹肌溶解症的药物是
A. 考来烯胺
B. 辛伐他汀
C. 普罗布考
D. 氯贝丁酯
E. 非诺贝特

正确答案：B。辛伐他汀